下列属于等张溶液的是
A. 0.9%NaCl
B. 0.9%葡萄糖
C. 1.9%尿素
D. 5%NaCl
E. 10%葡萄糖

正确答案：A。0.9%NaCl